关于高压蒸气灭菌法，不正确的描述是
A. 灭菌效果最可靠
B. 适用于对耐高温和耐湿物品的灭菌
C. 可杀灭包括细菌芽胞在内的所有微生物
D. 通常灭菌压力为2.05kg/cm2
E. 通常灭菌温度为121.3℃

正确答案：D。通常灭菌压力为2.05kg/cm2

解析：高压蒸汽灭菌法可杀灭包括芽胞在内的所有微生物，是灭菌效果最好、应用最广的灭菌方法。方法是将需灭菌的物品放在高压锅内，加热时蒸汽不外溢，高压锅内温度随着蒸汽压的增加而升高。在103.4kPa（1.05kg/cm2）蒸汽压下，温度达到121.3℃，维持15～20分钟。适用于普通培养基、生理盐水、手术器械、玻璃容器及注射器、敷料等物品的灭菌。掌握“消毒与灭菌”知识点。